减鼻充血药通常用于缓解鼻塞症状，其所激动的受体是
A. α受体
B. M受体
C. N受体
D. H₁受体
E. β受体

正确答案：A。α受体

解析：本题考查减鼻充血药。减鼻充血药通常用于缓解鼻塞症状，其所激动的受体是α受体（A对）。减鼻充血药是α受体激动剂，可对鼻甲中的容量血管产生收缩作用，通过减少鼻黏膜中的血流而缓解鼻塞症状。